普鲁卡因安全剂量每小时不宜超过
A. 1g
B. 1.5g
C. 2g
D. 2．5g
E. 3g

正确答案：A。1g

解析：本题考查口腔常用局麻药普鲁卡因的特点。普鲁卡因属于短效脂类局麻药，临床常用于局部浸润麻醉或神经阻滞麻醉，安全剂量每小时不宜超过1g（A对），临床使用局麻药前必须了解其安全剂量，否则可能造成中毒反应。